与后室间支伴行的静脉
A. 心大静脉
B. 心中静脉
C. 心小静脉
D. 心前静脉
E. 心最小静脉

正确答案：B。心中静脉

解析：心中静脉（B对）起于心尖部，与右冠状动脉的后室间支伴行。